毛果芸香碱可激动瞳孔括约肌的
A. M胆碱受体，使瞳孔缩小
B. N胆碱受体，使瞳孔缩小
C. M胆碱受体，使瞳孔扩大
D. N胆碱受体，使瞳孔扩大
E. 以上均不对

正确答案：A。M胆碱受体，使瞳孔缩小

解析：毛果芸香碱可激动瞳孔括约肌的M胆碱受体，表现为瞳孔缩小，局部用药后作用可持续数小时至1天。掌握“毛果芸香碱”知识点。